羟甲基乙酰辅酶A还原酶抑制剂（他汀类）与贝丁酸类调节血脂药联用时可引起的严重不良反应是
A. 肾输尿管结石
B. 十二指肠溃疡
C. 急性心肌梗死
D. 横纹肌溶解症
E. 糖尿病坏疽

正确答案：D。横纹肌溶解症

解析：本题考查药物的相互作用。羟甲基乙酰辅酶A还原酶抑制剂（他汀类）与贝丁酸类调节血脂药联用时可引起的严重不良反应是横纹肌溶解症（D对）。他汀类药物与烟酸（>1g/d）、吉非贝齐或贝特类合用，可使横纹肌溶解和急性肾衰竭的发生率增加。调血脂药的典型不良反应有肌痛、肌病、横纹肌溶解症、肝脏转氨酶AST及ALT升高等。肾输尿管结石（A错）、十二指肠溃疡（B错）、急性心肌梗死（C错）、糖尿病坏疽（E错）均不是他汀类与贝丁酸类药合用的不良反应。